临床上常常不用作静脉穿刺的是
A. 颈外静脉
B. 头静脉
C. 大隐静脉
D. 肘正中静脉
E. 面静脉

正确答案：E。面静脉

解析：颈外静脉（A对）、头静脉（B对）、大隐静脉（C对）、肘正中静脉（D对）均为临床上常常用作静脉穿刺的血管。面静脉（E错，为本题正确答案）无静脉瓣，临床上常常不用作静脉穿刺。